某学生寝室，共住2名女生，甲女活泼好动，每周有3～4天与同学一起打乒乓球。乙女整日课后都待在寝室看书，又喜欢吃零食，体重达100kg。乙女比甲女更容易得什么慢性病
A. 冠心病
B. 白内障
C. 风湿性关节炎
D. 耳聋
E. 胃癌

正确答案：A。冠心病